果实表面紫红色、红色或暗红色，有时出现白霜的药材是
A. 乌梅
B. 蔓荆子
C. 瓜蒌
D. 五味子
E. 吴茱萸

正确答案：D。五味子

解析：本题考查的是五味子药材的性状鉴别。果实表面紫红色、红色或暗红色，有时出现白霜的药材是五味子（D对）。五味子：【性状鉴别】药材呈不规则的球形或扁球形。表面红色、紫红色或暗红色，皱缩，显油润；有的表面呈黑红色或出现“白霜”；果肉柔软，种子肾形，表面棕黄色，有光泽，种皮薄而脆。果肉气微，味酸；种子破碎后，有香气，味辛、微苦。乌梅（A错）：【性状鉴别】药材呈类球形或扁球形。表面乌黑色或棕黑色，皱缩不平，基部有圆形果梗痕。果核坚硬，椭圆形，棕黄色，表面有凹点；种子扁卵形，淡黄色。气微，味极酸。蔓荆子（B错）药材表面具粉霜状茸毛。瓜蒌（C错）：【性状鉴别】药材呈类球形或宽椭圆形。表面橙红色或橙黄色，皱缩或较光滑，顶端有圆形的花柱残基，基部略尖，具残存的果梗。轻重不一。质脆，易破开，内表面黄白色，有红黄色丝络，果瓤橙黄色，黏稠，与多数种子黏结成团。具焦糖气，味微酸、甜。吴茱萸（E错）：【性状鉴别】药材呈球形或略呈五角状扁球形。表面暗黄绿色至褐色，粗糙，有多数点状突起或凹下的油点。顶端有五角星状的裂隙，基部残留被有黄色茸毛的果梗。质硬而脆，横切面可见子房5室，每室有淡黄色种子1粒。气芳香浓郁，味辛辣而苦。